患者，女，40岁。仰卧时腹部呈蛙状，侧卧时下侧腹部明显膨出。应首先考虑的是
A. 胃肠胀气
B. 腹腔积液
C. 巨大卵巢囊肿
D. 肥胖
E. 子宫肌瘤

正确答案：B。腹腔积液

解析：本例患者为中年女性，平卧位时呈现出蛙腹，侧卧时下侧腹部明显膨出，随体位变化明显，诊断应首先考虑的是腹腔积液（B对）。胃肠胀气（A错）、巨大卵巢囊肿（C错）、肥胖（D错）、子宫肌瘤（E错）表现为腹部局部膨隆，移动体位时其形状无明显改变。